关于肾的位置，错误的说法是
A. 左肾略高于右肾
B. 肾门约平第1腰椎高度
C. 肾上端距正中线较远，而肾下端距中线较近
D. 第12肋斜越左肾后面的中部、右肾后面的上部
E. 右肾上端平第12胸椎锥体上缘

正确答案：C。肾上端距正中线较远，而肾下端距中线较近

解析：因受肝的挤压，右肾低于左肾（A对）。肾上端距正中线较近，而肾下端距中线较远（C错，为本题正确答案）。肾门约在第 1 腰椎椎体平面（B对），右肾位置上端平第12胸椎锥体上缘（E对）。左、右两侧的第12肋分别斜过左肾后面中部和右肾后面上部（D对）。